对于普通中小学、农业中学、职业中学学生的体育锻炼时间，教育部颁布的“学校体育工作条例”中有明确的规定。以下说法错误的是
A. 每天应当安排课间操
B. 每周安排3次以上课外体育活动
C. 保证中学生每天至少有1小时的体育锻炼时间
D. 保证小学生每天有0.5小时的体育锻炼时间
E. 饭前、饭后1小时内不宜组织剧烈运动

正确答案：D。保证小学生每天有0.5小时的体育锻炼时间